内庭穴的定位是
A. 足背，第4、5趾间，趾蹼缘后方赤白肉际处纹头上凹陷处
B. 足背，第3、4趾间，趾蹼缘后方赤白肉际处纹头上凹陷处
C. 足背，第2、3趾间缝纹端
D. 足背，第1、2趾间的跖骨结合部之前凹陷
E. 足背，第1、2趾间的趾蹼缘上方纹头处

正确答案：C。足背，第2、3趾间缝纹端

解析：内庭定位在足背，第2、3趾间，趾蹼缘后方赤白肉际处（C对）。